应采取的处理是
A. 继续操作吸宫
B. 请上级大夫再次探宫腔深度
C. 立即剖腹探查
D. 后穹窿穿刺确定有无内出血
E. 严密观察1周后再吸宫

正确答案：E。严密观察1周后再吸宫

解析：患者人工流产术中，探针探宫腔深度14cm（子宫长7～8cm），且无明显腹痛，无阴道流血，考虑子宫穿孔。应停止手术，严密观察1周后再吸宫（E对AB错）。对于破口大、有内出血或怀疑脏器损伤，应剖腹探查（C错）。后穹窿穿刺确定有无内出血（P54）（D错）适用于疑有腹腔内出血的患者，多用于异位妊娠破裂的诊断。